连某因患严重的躁狂抑郁障碍，正在精神病专科医院住院治疗。因病情恶化，患者出现伤人毁物等行为，医院在没有其他可替代措施的情况下，对其实施了约束身体的措施，但实施后没有及时通知连某的监护人。连某的父亲作为监护人探视时，看到儿子被捆绑在病床上非常气愤。对患者连某实施身体约束而未告知其监护人的做法，侵犯的患方权利是
A. 生命权
B. 健康权
C. 认知权
D. 知情权
E. 名誉权

正确答案：D。知情权

解析：依照《精神卫生法》规定，实施保护性医疗措施应当遵循诊断标准和治疗规范，并在实施后告知患者的监护人。知情同意权，知情同意是创伤性医疗行为排除违法性的过程和依据，是指患者有权知晓自己的病情，并可以对医务人员所采取的防治医疗措施决定取舍的权利。该医院对患者实施约束身体的保护性医疗措施后，没有及时通知患者的监护人，侵犯了患方的知情权（D对）。